直接舒张小动脉平滑肌的药物是
A. 可乐定
B. 利血平
C. 哌唑嗪
D. 肼屈嗪
E. 卡托普利

正确答案：D。肼屈嗪

解析：本题考查直接舒张小动脉平滑肌的药物。直接舒张小动脉平滑肌的药物是肼屈嗪（D对）。肼屈嗪通过直接松弛小动脉平滑肌，降低外周阻力而降压。对静脉的作用较弱，一般不引起直立性低血压。可乐定（A错）为中枢性降压药。利血平（B错）为交感神经末梢抑制剂。哌唑嗪（C错）为是α₁受体阻断剂。卡托普利（E错）是血管紧张素Ⅰ转化酶抑制剂。